非处方药的合理使用包括
A. 自行判断找准适应症
B. 自行购买无病早用
C. 病愈为止，防止滥用
D. 按说明书介绍用药
E. 按疗程购买使用

正确答案：A、C、D、E。自行判断找准适应症；病愈为止，防止滥用；按说明书介绍用药；按疗程购买使用